男孩，10个月，因高热7天伴皮疹来院。查体：发育正常，皮肤可见红色斑疹，右颈部淋巴结1.5cm×2cm，咽红，扁桃体Ⅰ度，口唇干红，双肺呼吸音清，心尖区可闻及2/6SM，腹软，肝、脾不大，四肢末端红肿。实验室检査：HB100g/L，WBC13×109/L，N0.78，L0.22，PLT352×109/L，ESR70mm/h，ERP（+），ASO100U。该患儿的最佳治疗是
A. 阿司匹林+糖皮质激素
B. 静脉注射丙种球蛋白+阿司匹林
C. 阿司匹林
D. 糖皮质激素
E. 静脉注射丙种球蛋白

正确答案：B。静脉注射丙种球蛋白+阿司匹林

解析：大剂量丙种球蛋白静脉滴注（IVIG）可阻断急性炎症反应并具预防冠状动脉病变作用。推荐在病程10天内使用，应用过IVIG的患儿在9个月内不宜进行麻疹、风疹、腮腺炎疫苗的预防接种。掌握“川崎病”知识点。